根据《药品经营质量管理规范》和相关规定，药品经营企业应建立真实、完整和可追溯的药品采购、验收、养护、销售、不合格药品处理等书面记录和相应凭证，第二类精神药品经营企业在药品库房中的专用账册的保存期限是
A. 超过药品有效期1年，不得少于5年
B. 至少5年
C. 超过药品有效期1年，不得少于3年
D. 至药品有效期期满之日起不少于5年

正确答案：D。至药品有效期期满之日起不少于5年

解析：本题考查第二类精神药品的储存。根据《药品经营质量管理规范》和相关规定，药品经营企业应建立真实、完整和可追溯的药品采购、验收、养护、销售、不合格药品处理等书面记录和相应凭证，第二类精神药品经营企业在药品库房中的专用账册的保存期限是至药品有效期期满之日起不少于5年（D对）。第二类精神药品经营企业，应当在药品库房中设立独立的专库或者专柜储存第二类精神药品，并建立专用账册，实行专人管理。专用账册的保存期限应当自药品有效期期满之日起不少于5年。药品批发企业购进药品，应当建立并执行进货检查验收制度，索取、查验、留存《药品经营监督管理办法》规定的供货企业及其授权委托销售人员有关证件资料、销售凭证（保存至超过药品有效期1年，且不得少于5年（A错）），在验明药品合格证明和其他标识等证明药品合法性材料后方可购进、销售；不符合规定的，不得购进和销售。药品批发企业应当严格审核药品购货单位资质，按照其药品生产范围、经营范围或诊疗范围向其销售药品。医疗机构购进药品应当逐批验收，并建立真实、完整的药品验收记录；药品验收记录应当包括药品通用名称、生产厂商、规格、剂型、批号、生产日期、有效期、批准文号、供货单位、数量、价格、购进日期、验收日期、验收结论等内容；验收记录必须按规定保存至超过药品有效期1年，但不得少于3年（C错）。妥善保存首次购进药品加盖供货单位原印章的前述证明文件的复印件，保存期不得少于5年（B错）。